下列辅料中，可作为肠溶性包衣材料的是
A. HPMCP
B. HPC
C. HPMC
D. PVA
E. PVP

正确答案：A。HPMCP

解析：本题考查片剂的包衣。HPMCP（A对）即羟丙甲纤维素酞酸酯，属于肠溶型薄膜包衣材料；羟丙纤维素（HPC）（B错）、羟丙甲纤维素（HPMC）（C错）、聚乙烯比咯烷酮（PVP）（E错）均为胃溶型薄膜包衣材料；聚乙烯醇（PVA）（D错）可作黏合剂或润滑剂。